首选大环内酯类抗生素治疗的是
A. 干酪性肺炎
B. 肺炎球菌肺炎
C. 葡萄球菌肺炎
D. 肺炎支原体肺炎
E. 克雷伯杆菌肺炎

正确答案：D。肺炎支原体肺炎

解析：肺炎支原体肺炎首选大环内酯类抗生素治疗（D对）。干酪性肺炎（A错）需要抗结核治疗，首选异烟肼、利福平、吡嗪酰胺和乙胺丁醇。肺炎球菌肺炎（B错）首选青霉素G。葡萄球菌肺炎（C错）首选耐青霉素酶的半合成青霉素或头孢菌素。克雷伯杆菌肺炎（E错）治疗首选氨基糖苷类抗生素。